主载国外输入的药物的本草
A. 神农本草经
B. 新修本草
C. 海药本草
D. 本草纲目
E. 植物名实图考

正确答案：C。海药本草

解析：本题考查的是《海药本草》。主载国外输入的药物的本草海药本草（C对）。《海药本草》收载外国输入的药物。《神农本草经》（A错）简称《本经》，为汉代本草代表作。该书虽假托传说中的神农而作，但并非出于一时一人之手，而是经历了较长时间的补充和完善。《新修本草》（B错）又称《唐本草》，为隋唐时期唐代的本草代表作。书中除本草正文外，还增加了药物图谱，并附以文字说明，开创了图文对照法编撰药学专著的先例。《本草纲目》（D错）简称《纲目》，为明代本草代表作。该书的作者为伟大医药学家李时珍，他采用多学科综合研究的方法，以毕生精力对本草学进行了全面深入的研究整理。《植物名实图考》（E错），植物学著作，38卷。该书考订植物名实，然涉及药用植物甚多。共载植物1714种，仿《本草纲目》分谷、蔬、山草、隰草、石草、水草、蔓草、芳草、毒草、群芳、果、木12类。附图1805幅，绝大多数系写生而成。书中一般一物一图，图文对照。